根据行为改变阶段理论，当行为改变处于第一阶段（没有准备阶段）时，相应的干预策略是
A. 提供方法，鼓励尝试
B. 激发动机，支持鼓励
C. 继续支持，不断强化
D. 环境支持，预防复发
E. 提供信息，提高认识

正确答案：E。提供信息，提高认识